在下列医务人员的行为中，不符合有利原则的是
A. 与解除病人的疾苦有关
B. 可能解除病人的疾苦
C. 使病人受益且产生的副作用很小
D. 使病人受益，但却给别人造成了较大的伤害
E. 在人体实验中，可能使受试者暂不得益，但却使社会后代受益很大

正确答案：D。使病人受益，但却给别人造成了较大的伤害

解析：有利原则指把有利于病人健康放在第一位并切实为其谋利益的伦理原则，医生对利害得失全面权衡，选择受益最大、伤害最小的医学决策。使病人受益，但却给别人造成了较大的伤害（D错，为本题正确答案）不符合有利原则。医务人员的行动解除病人的疾苦（AB对），符合有利原则。医疗过程或多或少会有一定的副作用，不存在绝对的不伤害，最优化原则要求医务人员的行动要抓住问题的主要矛盾，因此使病人受益且产生的副作用很小（C对）时，仍应首先选择治疗病人的主要疾病，也符合有利原则。受各种客观条件的制约，在人体实验中，可能使受试者暂不得益，但却使社会后代受益很大（E对），也符合有利原则。